医学道德的最高境界是
A. 公私不分
B. 大公无私
C. 先公后私
D. 先私后公
E. 自私自利

正确答案：B。大公无私

解析：医学道德的最高境界是大公无私。掌握“医学道德修养”知识点。